关于前瞻性队列研究基本特征的叙述，下列哪项最恰当
A. 调查者必须在研究人群发病或死亡发生前就开始研究，同时确定暴露状况
B. 调查者必须根据疾病或死亡发生前就已存在的暴露因素对研究人群加以分组，并能发现该人群中的新发病例或死亡人数
C. 调查者必须在研究开始时就分清人群队列
D. 调查者必须选择病例对照并测量暴露
E. 调查者必须比较队列中暴露组非暴露组的发病率

正确答案：A。调查者必须在研究人群发病或死亡发生前就开始研究，同时确定暴露状况

解析：本题考查前瞻性队列研究的特点。前瞻性队列研究是队列研究的基本形式。研究对象的分组是根据研究对象现时的暴露状况而定的，此时研究的结局还没有出现（A对BCDE错），需要前瞻观察一段时间才能得到。前瞻性队列研究中的资料的偏倚较小，结果可信；但所需观察的人群样本很大，观察时间长、花费大。